某学校将土操场改成了塑胶操场，改善了
A. 学校卫生政策
B. 学校物质环境
C. 学校社会环境
D. 个人健康技能
E. 卫生服务

正确答案：B。学校物质环境